治疗胆固醇和三酰甘油酯均高者宜选用
A. 贝丁酸类
B. 羟甲戊二酰辅酶A还原剂抑制剂
C. 烟酸
D. 胆酸螯合剂+贝丁酸类
E. 鹅去氧胆酸

正确答案：D。胆酸螯合剂+贝丁酸类

解析：本题考查调血脂药。胆酸螯合剂+贝丁酸类（D对）为联合用药，可用于治疗胆固醇和三酰甘油均高者。贝丁酸类（A错）为治疗高三酰甘油血症的首选。羟甲戊二酰辅酶A还原剂抑制剂（B错）为治疗高胆固醇血症的首选。烟酸（C错）用于高三酰甘油血症和以三酰甘油升高为主的混合性高脂血症。鹅去氧胆酸（E错）为利胆剂。